亚硫酸氢钠在维生素C注射液处方中的作用是
A. 抗氧剂
B. pH调节剂
C. 金属离子络合剂
D. 着色剂
E. 矫味剂

正确答案：A。抗氧剂

解析：本题考查注射剂常用附加剂。维生素C注射液处方分析：维生素C-主药；依地酸二钠-金属螯合剂（C错）；碳酸氢钠-pH调节剂（B错）；亚硫酸氢钠-抗氧剂（A对）；注射用水-溶剂。此处方中无着色剂（D错）和矫味剂（E错）。